女，42岁，发现心脏杂音三年，查体：血压120/70mmHg，律齐，双肺呼吸音清，未闻及干湿啰音，律齐，心尖部可闻及3/6收缩期杂音和舒张期隆隆样杂音。可能的诊断是
A. 三尖瓣关闭不全伴狭窄
B. 二尖瓣关闭不全伴狭窄
C. 二尖瓣狭窄
D. 三尖瓣关闭不全
E. 二尖瓣关闭不全

正确答案：B。二尖瓣关闭不全伴狭窄

解析：女性患者，42岁（40~50岁），有心脏杂音史，查体：心尖部闻及3/6收缩期杂音和舒张期隆隆样杂音，最可能的诊断为二尖瓣关闭不全伴狭窄（B对CE错）。三尖瓣关闭不全的杂音特点是胸骨左下缘全收缩期杂音，三尖瓣狭窄一般听不到杂音（AD错）。